导致抗核抗体ANA阳性的主要疾病是
A. 多发性骨髓瘤
B. 原发性肝癌
C. 肝硬化
D. 系统性红斑狼疮
E. 甲状腺功能亢进症

正确答案：D。系统性红斑狼疮

解析：ANA对很多自身免疫性疾病有诊断价值。阳性多见于未经治疗的SLE.ANA阳性率可达95%上，但特异性较差。药物性狼疮、混合性结缔组织病、原发性胆汁性肝硬化、全身性硬皮病、多发性肌炎患者阳性率也较高（D对）。多发性骨髓瘤起病徐缓，早期无明显症状，容易被误诊。MM的临床表现多样，主要有贫血、骨痛、肾功能不全、感染、出血、神经症状、高钙血症、淀粉样变等（A错）。血清甲胎蛋白（AFP）测定对诊断原发性肝癌有相对的特异性。放射免疫法测定持续血清AFP≥400μg/L，并能排除妊娠、活动性肝病等，即可考虑肝癌的诊断。临床上约30%的肝癌病人AFP为阴性。如同时检测AFP异质体，可使阳性率明显提高（B错）。肝硬化患者抗线粒体抗体（AMA）可为阳性（C错）。甲亢患者甲状腺分泌的T₃、T₄、FT₃、FT₄明显升高，由于甲状腺和垂体轴的反馈作用，TSH常常降低。如果一个患者的T₃、T₄、FT₃、FT₄升高，同时伴TSH下降，即甲状腺功能亢进。由于甲亢多数是Graves病，是甲状腺自身免疫病，所以常常伴随甲状腺自身抗体升高，甲状腺球蛋白抗体和甲状腺过氧化物酶抗体升高，Graves病患者是由于滤胞细胞产生了一种刺激甲状腺功能的免疫球蛋白-TSI，所以临床检验促甲状腺素（TSH）受体抗体-TRAb阳性。（E错）